患儿，男，5岁，体重25kg，有癫痫病史，青霉素过敏史。因急性胆囊炎合并腹腔感染住院治疗，体征和实验室检查：白细胞计数15.8×10³/L，体温39.5℃，肝、肾功能正常，医师处方美罗培南静脉滴注（说明书规定儿童剂量为一次20mg/kg）。用药过程中，若癫痫复发，不可选用的抗癫痫药是
A. 丙戊酸钠
B. 乙琥胺
C. 地西泮
D. 左乙拉西坦
E. 氯硝西泮

正确答案：A。丙戊酸钠

解析：本题考查药物的联合应用。美罗培南与丙戊酸钠（A错，为本题正确答案）合用时，可促进丙戊酸钠代谢，导致其血浆药物浓度降低，可能引发癫痫。